某女，35岁，近因火毒血热而致身热烦躁，目赤口疮，咽喉及牙龈肿痛，大便秘结，咳血，衄血，治当清热泻火解毒、化瘀凉血止血，宜选用的成药是
A. 芩连片
B. 黛蛤散
C. 西黄丸
D. 一清颗粒
E. 牛黄至宝丸

正确答案：D。一清颗粒

解析：本题考查的是一清颗粒的功能与主治。近因火毒血热而致身热烦躁，目赤口疮，咽喉及牙龈肿痛，大便秘结，咳血，衄血，治当清热泻火解毒、化瘀凉血止血，宜选用的成药是一清颗粒（D对）。一清颗粒：【功能】清热泻火解毒，化瘀凉血止血。【主治】火毒血热所致的身热烦躁、目赤口疮、咽喉及牙龈肿痛、大便秘结、吐血、咯血、衄血、痔血；咽炎、扁桃体炎、牙龈炎见上述证候者。芩连片（A错）：【功能】清热解毒，消肿止痛。【主治】脏腑蕴热，头痛目赤，口鼻生疮，热痢腹痛，湿热带下，疮疖肿痛。黛蛤散（B错）：【功能】清肝利肺，降逆除烦。【主治】肝火犯肺所致的头晕耳鸣、咳嗽吐衄、痰多黄稠、咽膈不利、口渴心烦。西黄丸（C错）：【功能】清热解毒，消肿散结。【主治】热毒壅结所致的痈疽疔毒、瘰疬、流注、癌肿。牛黄至宝丸（E错）：【功能】清热解毒，泻火通便。【主治】胃肠积热所致的头痛眩晕、目赤耳鸣、口燥咽干、大便燥结。